患者女性20岁，因龋坏牙就诊。查：左下7颊（牙合）面点隙龋，探质软，卡探针，冷热测同对照牙，口内多个牙因龋坏充填治疗，该患牙最好的处理为
A. 银汞充填龋坏涉及的部位
B. 玻璃离子充填龋坏涉及的部位
C. 预防性扩展，银汞合金充填
D. 预防性扩展，玻璃离子充填
E. 预防性扩展，复合树脂充填

正确答案：C。预防性扩展，银汞合金充填

解析：本题考查银汞合金充填术。患者女性20岁，因龋坏牙就诊。查：左下7颊（牙合）面点隙龋，探质软，卡探针，冷热测同对照牙，口内多个牙因龋坏充填治疗，该患牙最好的处理为预防性扩展，银汞合金充填（C对）。患牙为左下7，承受的咬合力较大，要求充填材料具有抗压强度好，耐磨性强，因此预防性扩展，银汞合金充填为最佳处理方法。患者口内有多个牙因龋坏充填治疗，可见患者易患龋，且为（牙合）面点隙龋，在备洞时应该进行预防性扩展，故银汞充填龋坏涉及的部位和玻璃离子充填龋坏涉及的部位不适用于该患牙（AB错）。玻璃离子强度较低，不耐磨，一般不用于后牙（牙合）面的充填（D错）。复合树脂充填也可用于该患牙，但是复合树脂的强度及耐磨性均不及银汞合金，故不是最佳的处理方法（E错）。